复元活血汤中配伍大黄的临床意义是
A. 泻热降火解毒
B. 泻热凉血止血
C. 泻热荡涤通便
D. 泻除湿热瘀结
E. 荡涤凝瘀败血

正确答案：E。荡涤凝瘀败血

解析：复元活血汤方中含有柴胡、瓜蒌根、当归、红花、甘草、穿山甲、大黄、桃仁，具有活血祛瘀，疏肝通络之功效。主治跌打损伤，瘀血阻滞证。胁肋瘀肿，痛不可忍。方中重用酒制大黄，荡涤凝瘀败血，导瘀下行，推陈致新（E对）。